下列不属于学校卫生服务评价指标的是
A. 患病率
B. 检出率
C. 月病假率
D. 人均病假日数
E. 健康行为形成率

正确答案：E。健康行为形成率